骨髓增生异常综合征患者的骨髓原始细胞中有Auer小体，见于
A. RA型
B. RSA型
C. CMML型
D. RAEB型
E. RAEB-t型

正确答案：E。RAEB-t型

解析：骨髓增生异常综合征根据FAB分型可分为RA、RAS、RAEB、RAEB-t、CMML5型，原始细胞中出现Auer小体即可诊断为RAEB-t型（E对）。RAEB-t型（E对）骨髓象特点是原始细胞＞20%而＜30%，或幼粒细胞出现Auer小体；RA（A错）骨髓象特点是原始细胞＜5%；RAS（B错）的骨髓象特点是原始细胞＜5%，环形铁粒幼细胞比例＞有核红细胞的15%；RAEB（D错）骨髓象特点是原始细胞增多，5%～20%；CMML型（C错）主要特点是外周血单核细胞绝对值＞1×10⁹/L，骨髓原始细胞增多，5%～20%。